注射剂的质量要求不包括
A. 无菌
B. 无热原
C. 无可见异物
D. 无不溶性微粒
E. 无色

正确答案：E。无色

解析：本题考查注射剂的质量要求。注射剂的质量要求不包括无色（E错，为本题正确答案），临床上使用的部分注射剂也具有一定的颜色，如含有铁离子的注射剂。注射剂的质量要求：1.pH 注射剂的pH应和血液pH相等或相近。一般控制在4～9的范围内。也可根据具体品种确定，同一品种的pH允许差异范围不超过±1.0。2.渗透压 对用量大、供静脉注射的注射剂应具有与血浆相同的或略偏高的渗透压。3.稳定性 注射剂要具有必要的物理稳定性和化学稳定性，以确保产品在贮存期内安全、有效。4.安全性 注射剂必须对机体无毒性、无刺激性，降压物质必须符合规定，确保安全。5.澄明 溶液型注射液应澄明，不得含有可见的异物（C对）或不溶性微粒（D对）。6.无菌（A对） 注射剂内不应含有任何活的微生物。7.无热原（B对） 注射剂内不应含热原，热原检查必须符合规定。